患者，男性，42岁。有胃溃疡病史。近日发现手指关节肿胀，疼痛，早晨起床后感到指关节明显僵硬，活动后减轻，经化验后确诊为类风湿性关节炎，应选用哪种药物治疗
A. 阿司匹林
B. 对乙酰氨基酚
C. 布洛芬
D. 吗啡
E. 吡罗昔康

正确答案：E。吡罗昔康